一新婚女性将要去度蜜月，暂不希望怀孕，应该采取的避孕措施是
A. 短效口服避孕药
B. 宫内节育器
C. 长效避孕药
D. 安全期避孕
E. 皮下埋植避孕法

正确答案：A。短效口服避孕药

解析：本题考查常用的避孕方法。对于新婚后暂无生育计划的对象，必须授予避免意外妊娠的知识与方法。 避孕的本质就是利用科学的方法干扰受孕的必备条件达到暂时性不孕的目的。这一人群的共同特点是生活节奏快，忙于事业而疏于避孕，宜选择安全、有效、可逆、停用后迅速恢复生育的避孕方法，重要的是必须使用方便。短期避孕宜选用短效的避孕方法如避孕套和复方短效口服避孕药（A对BCDE错）。